导致脑梗死最常见的病因是
A. 分水岭脑梗死
B. 短暂性脑缺血发作
C. 脑栓塞
D. 脑血栓形成
E. 腔隙性脑梗死

正确答案：D。脑血栓形成

解析：依据局部脑组织发生缺血坏死的机制可将脑梗死分为三种主要病理生理学类型：脑血栓形成、脑栓塞和血流动力学机制所致的脑梗死。前两种约占全部急性脑梗死的80%-90%。导致脑梗死最常见的病因是脑血栓形成（D对）是因为局部血管本身存在病变而继发血栓形成所致，动脉粥样硬化是本病的根本病因。分水岭脑梗死（A错）是由相邻脑血管供血区交界处或分水岭区局部缺血导致，也称边缘带脑梗死，为少见脑梗死类型（P179）。短暂性脑缺血发作（TIA）（B错）是由于局部脑或视网膜缺血引起的短暂性神经功能缺损，可发展成脑梗死，但不是脑梗死的病因（P172）。脑栓塞（C错）是指各种栓子随血流进入颅内动脉使血管腔急性闭塞或严重狭窄，引起相应供血区脑组织发生缺血坏死及功能障碍的一组临床综合征，约占全部脑梗死的1/3（P184）。腔隙性脑梗死（E错）是指大脑半球或脑干深部的小穿通动脉，在长期高血压等危险因素基础上，血管壁发生病变，最终管腔闭塞，导致供血动脉脑组织发生缺血坏死，约占全部脑梗死的20%-30%（P186）。